两药合用，以一种药为主，另一种药为辅，辅药能提高主药疗效的配伍关系，称为
A. 相使
B. 相杀
C. 相畏
D. 相反
E. 相恶

正确答案：A。相使

解析：该题主要考查中药七情配伍理论。相使即以一种药为主，另一种药为辅，辅药能提高主药功效（A对）。